喹诺酮类抗菌药可与钙、镁、铁等金属离子形成螯合物，是因为分子中存在
A. 7位哌嗪基团
B. 6位氟原子
C. 8位甲氧基
D. 1位烃基
E. 3位羧基和4位酮羰基

正确答案：E。3位羧基和4位酮羰基

解析：本题考查喹诺酮类抗菌药。喹诺酮类抗菌药分子中的关键药效团是3位羧基和4位羰基（E对），该药效团极易和钙、镁、铁、锌等金属离子螯合，造成体内的金属离子流失，引起妇女、老人和儿童缺钙、贫血、缺锌等副作用。7位哌嗪基团（A错）为喹诺酮类抗菌药活性的重要基团。6位的氟原子（B错）增加抗菌活性增加。喹诺酮类药物1位烃基（D错）影响药物的抗菌活性。8-甲氧基（C错）取代时能够减小光毒性。